药物依赖是指个体对药物产生
A. 精神依赖
B. 躯体依赖
C. 耐受性增加
D. 精神和躯体依赖
E. 耐受性降低

正确答案：D。精神和躯体依赖

解析：药物依赖又称药物成瘾，是指在长期应用某种药物后，机体对这种药物产生了生理性或精神性的依赖和需求，分精神和躯体依赖（生理依赖）（D对AB错）。耐受性是一种状态，指药物使用者必须增加使用剂量方能获得所需的效果，或使用原来的剂量则达不到使用者所追求的效果（CE错）。